治疗外感风寒，恶寒发热，双侧肩关节疼痛应首选
A. 紫珠
B. 羌活
C. 藁本
D. 辛夷
E. 柴胡

正确答案：B。羌活

解析：羌活主要应用于风寒感冒，头痛项强，风寒湿痹，肩背酸痛（B对）。紫珠（A错）既能收敛止血，又能凉血止血，善治各种内外伤出血，尤多用于肺胃出血证。藁本（C错）辛温香燥，善达巅顶，常用治太阳风寒，循经上犯，症见头痛，鼻塞，巅顶痛。辛夷（D错）善于治风寒头痛，鼻渊，鼻塞流涕。柴胡（E错）善于治感冒发热，寒热往来，肝郁气滞，胸胁胀痛，月经不调。